男，36岁。高血压3年，下肢乏力，血钾2.9mmol/L。则该患者可能得到的分析结果是
A. 血醛固酮低、肾素活性高、皮质醇高
B. 血醛固酮低、肾素活性高、皮质醇低
C. 血醛固酮低、肾素活性低、皮质醇正常
D. 血醛固酮高、肾素活性高、皮质醇正常
E. 血醛固酮低、肾素活性高、皮质醇正常

正确答案：D。血醛固酮高、肾素活性高、皮质醇正常

解析：青年男性患者，出现高血压、低钾血症（醛固酮增多症的典型表现）及肌无力，考虑诊断为醛固酮增多症。醛固酮增多症分为原发性醛固酮增多症与继发性醛固酮增多症。原发性醛固酮增多症血醛固酮升高，由于肾素-血管紧张素-醛固酮系统轴的存在，血醛固酮水平升高会负反馈性地抑制肾素及血管紧张素的分泌并下调其活性。继发性醛固酮增多症可继发于肾素-血管紧张素系统亢进，此时肾素活性升高，导致血醛固酮增多。醛固酮并不受皮质醇的调节，也不调节皮质醇，故皮质醇含量正常（D对）。